以精神分析理论为基础的疗法是
A. 自由联想疗法
B. 森田疗法
C. 询者中心疗法
D. 系统脱敏疗法
E. 支持疗法

正确答案：A。自由联想疗法